能疏风散寒、祛痰止咳的中成药是
A. 荆防败毒丸
B. 参苏片
C. 三金感冒片
D. 感特灵胶囊
E. 贯防感冒片

正确答案：B。参苏片

解析：本题考查的是参苏丸的功能。能疏风散寒、祛痰止咳的中成药是参苏片（B对）。参苏丸：【功能】益气解表，疏风散寒，祛痰止咳。感特灵胶囊（D错）：【功能】清热解毒，清肺止咳。荆防败毒丸（A错）、三金感冒片（C错）与贯防感冒片（E错）的功能，2022年考试指南未明确说明。